患者身热，烦躁，汗出不解，呕恶，脘腹胀满疼痛，大便溏垢不爽，舌苔黄腻，脉滑数
A. 湿滞脾胃证
B. 湿热积滞肠腑证
C. 阳明热结证
D. 阳明热炽证
E. 湿热中阻证

正确答案：B。湿热积滞肠腑证

解析：湿热侵袭大肠，壅阻气机，故见脘腹胀满疼痛；湿热内迫肠道，大肠传导失常，故见大便溏垢不爽；故辨证为湿热积滞肠腑证（B对）。湿滞脾胃证表现为胸腹胀满，口淡不渴，不思饮食，或有恶心呕吐，大便溏泻，困倦嗜睡，舌不红，苔厚腻（A错）。阳明热结证表现为日晡潮热，时有谵语，大便秘结，或纯利恶臭，肛门灼热，腹部胀满硬痛拒按，苔黄而燥，甚者灰黑而燥，脉沉实有力（C错）。阳明热炽证表现为壮热，恶热，面赤，汗大出，心烦，渴喜冷饮，舌质红苔黄而燥，脉洪大或滑数（D错）。湿热中阻证表现为胃脘疼痛，或引背，嘈杂灼热，得食不减，口干口苦，渴不喜饮，头重如裹，身重肢倦，纳呆恶心，小便色黄，大便不畅，舌红、苔黄腻、脉滑数（E错）。